女，56岁，G₄P₂。绝经5年，阴道脱出肿物4年，脱出肿物增大3个月。不能自行回缩，伴排尿困难。妇科检查见宫颈及部分宫体已脱出于阴道口外。妇科超声及泌尿系统超声均未提示异常。适宜的处理为
A. 阴道全封闭术
B. 经腹圆韧带缩短术
C. 阴道半封闭术
D. 盆底修复及子宫切除术
E. Manchester手术

正确答案：D。盆底修复及子宫切除术

解析：中年女性患者，G₄P₂。绝经5年，阴道脱出肿物4年，脱出肿物增大3个月。不能自行回缩，伴排尿困难。妇科检查见宫颈及部分宫体已脱出于阴道口外。妇科超声及泌尿系统超声均未提示异常。综合患者的症状、体征和辅助检查，初步诊断为子宫脱垂Ⅱ度重型。适宜的处理为盆底修复及子宫切除术（D对）。阴道全封闭术（A错）、阴道半封闭术（C错）仅适用于年老体弱不能耐受较大手术者。经腹圆韧带缩短术（B错）适用于子宫脱垂轻型患者。Manchester手术（E错）适用于Ⅰ度或Ⅱ度子宫脱垂，伴有子宫颈延长，并发前后阴道壁膨出者。